关于复合固定桥的说法中，错误的是
A. 包括4个以上的牙单位
B. 整个固定桥中含有2个以上的牙单位
C. 承受外力时，各基牙受力反应多数不一致
D. 获得共同就位道比较困难
E. 复合固定桥常包括前牙和后牙

正确答案：B。整个固定桥中含有2个以上的牙单位

解析：复合固定桥是将两种或两种以上的简单固定桥组合成复合固定桥。如在双端固定桥的一端再连接一个半固定桥或单端固定桥。①复合固定桥一般包括四个或四个以上的牙单位，常包括前牙和后牙，形成程度不同弧形的固定桥，整个固定桥中含有两个以上基牙。②当承受外力时，各个基牙的受力反应不一致，可以相互支持或相互制约，使固定桥取得固位和支持。③反之，也可能影响到固定桥的固位而引起固位体和基牙之间松动。④复合固定桥包括的基牙数目多而且分散，要获得共同就位道比较困难。掌握“固定桥的组成和分类”知识点。